下列关于生长发育速度不均衡性的描述，不正确的是
A. 生长发育速度曲线量波浪式
B. 从胎儿到成人先后出现两次生长突增高峰
C. 第一次生长突增高峰从胎儿4个月至出生1年
D. 第二次生长突增高峰在青春发育早期
E. 和男孩相比，女孩在生长突增期的增幅大，但持续时间短

正确答案：E。和男孩相比，女孩在生长突增期的增幅大，但持续时间短